影响Ca²⁺通道，减少细胞内Ca²⁺浓度
A. 奎尼丁
B. 硝酸甘油
C. 地高辛
D. 卡托普利
E. 硝苯地平

正确答案：E。硝苯地平

解析：本题考查硝苯地平。影响Ca²⁺通道，减少细胞内Ca²⁺浓度的是硝苯地平（E对）。硝苯地平为钙通道阻滞药，钙通道阻滞药能选择性地阻断电压门控性Ca²⁺通道，抑制细胞外Ca²⁺内流，松弛血管平滑肌，降低外周血管阻力，使血压下降。二氢吡啶类（硝苯地平等）、苯烷胺类（维拉帕米等）和苯硫氮䓬类（地尔硫䓬）均具有一定的降压作用。奎尼丁（A错）为钠通道阻滞剂，基本作用是与钠通道蛋白质相结合而阻滞通道，适度抑制Na⁺内流，发挥抗心律失常作用；轻度阻滞Ca²⁺内流，具有负性肌力作用。硝酸甘油（B错）为硝酸酯类药物，硝酸酯类在平滑肌细胞能与硝酸酯受体结合，并被硝酸酯受体的巯基还原成NO或-SNO（亚硝巯基），释出的NO舒张血管，还能抑制血小板聚集和黏附，发挥对冠心病心绞痛的治疗作用。地高辛（C错）是通过增加兴奋时心肌细胞内Ca²⁺量发挥正性肌力作用。卡托普利（D错）有排钠作用，使细胞内Na⁺水平降低，Na⁺-Ca²⁺交换减弱，降低细胞内Ca²⁺水平。